《素问·诊要经终论》载“戴眼，反折，瘛瘲，其色白，绝汗乃出”，为什么脉的经气血衰竭
A. 少阳脉
B. 太阳脉
C. 太阴脉
D. 少阴脉
E. 阳明脉

正确答案：B。太阳脉

解析：由于循行部位的不同，以及所属脏腑功能的不同，因而，十二经脉气血衰败时，其所表现出的证候也有所不同，《素问·诊要经终论》即对此作出了总结：“太阳之脉，其终也戴眼反折瘈疭（B对），其色白，绝汗乃出，出则死矣。少阳终者，耳聋百节皆纵，目寰绝系（A错），绝系一日半死，其死也色先青白，乃死矣。阳明终者，口目动作，善惊妄言（E错），色黄，其上下经盛，不仁，则终矣。少阴终者，面黑齿长而垢，腹胀闭，上下不通而终矣（B错）。太阴终者，腹胀闭不得息，善噫善呕（C错），呕则逆，逆则面赤，不逆则上下不通，不通则面黑皮毛焦而终矣。厥阴终者，中热嗌干，善溺心烦，甚则舌卷卵上缩而终矣。此十二经之所败也”。